主要目标细菌耐药率超过50%的抗菌药物，应当
A. 慎重经验用药
B. 继续大剂量用药
C. 参照药敏试验结果选用
D. 及时将预警信息通报本机构医务人员
E. 暂停针对此目标细菌的临床应用，追踪、再决定是否恢复应用

正确答案：C。参照药敏试验结果选用

解析：主要目标细菌耐药率超过50%的抗菌药物，应当参照药敏试验结果选用。掌握“抗菌药物临床应用概述及管理”知识点。